某患者，右侧严重的三叉神经第Ⅱ、Ⅲ支痛伴痛性抽搐。所谓痛性抽搐，是指伴疼痛而发生的
A. 面部潮红
B. 眼结膜充血
C. 表情肌不自主痉挛
D. 咬唇、伸舌
E. 用力揉搓面部

正确答案：C。表情肌不自主痉挛

解析：本题考查三叉神经痛。某患者，右侧严重的三叉神经第Ⅱ、Ⅲ支痛伴痛性抽搐，应诊断为三叉神经痛。所谓痛性抽搐，是指伴疼痛而发生的表情肌不自主痉挛（C对）。面部潮红（A错）、眼结膜充血（B错）为三叉神经痛发作时的伴随症状，仅这些伴发症状不能称为痛性抽搐。咬唇、伸舌（D错）、用力揉搓面部（E错）为三叉神经痛发作时患者为减轻疼痛而做出的特殊动作。